D-二聚体是
A. 纤溶酶水解纤维蛋白原的产物
B. 纤溶酶水解纤维蛋白的产物
C. 纤溶酶水解凝血酶原的产物
D. 纤溶酶水解凝血酶的产物
E. 以上都不是

正确答案：B。纤溶酶水解纤维蛋白的产物

解析：纤溶酶水解纤维蛋白的产物（B对ACDE错）是D-二聚体